药物不良反应发生的机体方面原因包括
A. 种族差别
B. 个体差别
C. 病理状态
D. 营养状态
E. 性别年龄

正确答案：A、B、C、D、E。种族差别；个体差别；病理状态；营养状态；性别年龄